经第7颈椎下方的椎间孔穿出的神经是
A. 第5颈神经
B. 第6颈神经
C. 第7颈神经
D. 第8颈神经
E. 无

正确答案：D。第8颈神经

解析：第1颈神经在寰椎与枕骨之间的间隙离开椎管，第2~7颈神经经同序数颈椎上方的椎间孔穿出椎管，第8颈神经（D对）则在第7颈椎下方的椎间孔穿出椎管。